男性患者，27岁，1年来阵发性高血压升高，发作时剧烈头痛、面色苍白、心动过速等，平时血压正常且无症状。首选的检查是
A. 测定血浆肾素活性
B. 静脉肾盂造影
C. 肾动脉造影
D. 测定24小时尿儿茶酚胺和香草基杏仁酸
E. 24小时尿17-羟皮质类同醇

正确答案：D。测定24小时尿儿茶酚胺和香草基杏仁酸

解析：患者阵发性高血压升高，发作时剧烈头痛面色苍白心动过速等平时血压正常且无症状，可考虑嗜铬细胞瘤，首选的检查是测定24小时尿儿茶酚胺和香草基杏仁酸（D对）。疑为原发性醛固酮增多症，要测定血浆肾素活性（A错）。无症状性血尿或（和）蛋白尿要进行静脉肾盂造影检查（B错）。肾动脉狭窄可用肾动脉造影明确诊断（C错）。